因支气管静脉曲张破裂所致咯血最常见于
A. 肺结核
B. 肺脓肿
C. 肺栓塞
D. 二尖瓣狭窄
E. Wegener肉芽肿

正确答案：D。二尖瓣狭窄

解析：二尖瓣狭窄咯血是由于严重二尖瓣狭窄，左心房压力突然增高，肺静脉压增高，支气管静脉破裂出血所致（D对）。肺结核（A错）、肺脓肿（B错）咯血是由局部病灶直接破坏血管所致。肺栓塞（P98）（C错）是由来自静脉系统或右心的血栓阻塞肺动脉或其分支所致，肺动脉压力增高，肺静脉压降低，不会导致支气管静脉曲张破裂出血，肺栓塞咯血常为小量咯血，为肺毛细血管破裂所致。肉芽肿性多血管炎原来称为Wegener肉芽肿（P842）（E错），是一种坏死性肉芽肿性血管炎，病变累及全身小动脉、静脉及毛细血管，累及肺血管时可致咯血，常为肺血管炎症破坏所致。